大红肾见于
A. 弥漫性毛细血管内增生性肾小球肾炎
B. 弥漫性系膜增生性肾小球肾炎
C. 弥漫性新月体性肾小球肾炎
D. 弥漫性膜性增生性肾小球肾炎
E. 轻微病变性肾小球肾炎

正确答案：A。弥漫性毛细血管内增生性肾小球肾炎

解析：弥漫性毛细血管内增生性肾小球肾炎的肾脏表面充血，肾脏表面有散在的粟粒大小的出血点，称为大红肾或蚤咬肾（A对）。弥漫性新月体性肾小球肾炎（急进性肾小球肾炎）见双肾增大，苍白，有新月体形成（C错）。轻微病变性肾小球肾炎见肾脏肿胀，颜色苍白（E错）。